色谱系统适用性试验中，理论板数（n）用于评价
A. 固定相的极性
B. 色谱柱的分离效能
C. 色谱柱的长度
D. 色谱峰面积的重复性
E. 色谱峰的对称性

正确答案：B。色谱柱的分离效能

解析：本题考查色谱法。色谱系统适用性试验中，理论板数（n）用于评价色谱柱的分离效能（B对）。色谱柱的理论板数（n）用于评价色谱柱的分离效能。拖尾因子（T）用于评价色谱峰的对称性（E错）。